男性，60岁，因急性心肌梗死收入院。住院第2天心尖部出现2/6～3/6级粗糙的收缩期杂音，间断伴咯喇音，经抗缺血治疗后心脏杂音消失。该患者最可能的诊断是
A. 心脏乳头肌功能失调
B. 心脏乳头肌断裂
C. 心脏游离壁破裂
D. 心脏二尖瓣穿孔
E. 心室膨胀瘤

正确答案：A。心脏乳头肌功能失调

解析：患者老年男性，诊断为急性心肌梗死病，突发心尖部收缩期杂音，间断伴喀喇音，考虑乳头肌功能失调或断裂引起的二尖瓣脱垂并关闭不全所致。但患者经抗缺血治疗后杂音消失，而心脏乳头肌断裂（B错）为不可逆过程，不会出现杂音消失现象，因此该患者最可能的诊断是心脏乳头肌功能失调（A对）。心脏游离壁破裂（C错）常在1周内出现，常可在胸骨左缘第3～4肋间出现响亮的收缩期杂音，而不是心尖部。心脏二尖瓣穿孔（D错）可发生急性二尖瓣关闭不全（P292），此时心尖部会出现收缩期杂音，但不会出现经抗缺血治疗后心脏杂音消失现象。心室膨胀瘤（E错）可见左侧心界扩大，可有收缩期杂音，但绝不会在梗死后2天即出现。